治疗热病伤津，烦热口渴，呕逆时作，舌燥少津者，应首选
A. 石膏
B. 知母
C. 天花粉
D. 芦根
E. 栀子

正确答案：D。芦根

解析：热病伤津，烦热口渴，舌燥少津，治当清热泻火、生津止渴、除烦，呕逆时作，治当止呕，所以首选具有清热泻火，生津止渴，除烦止呕功效的药。芦根具有清热泻火，生津止渴，除烦，止呕，利尿的功效（D对）。石膏生用具有清热泻火，除烦止渴的功效，煅用具有敛疮生肌，收湿，止血的功效，无止呕之功（A错）。知母具有清热泻火，滋阴润燥的功效，无止呕之功（B错）。天花粉具有清热泻火，生津止渴，消肿排脓的功效，无止呕之功（C错）。栀子具有泻火除烦，清热利湿，凉血解毒的功效，无止呕之功（E错）。